西咪替丁所致的主要不良反应是
A. 腹痛
B. 黑便
C. 皮炎
D. 性功能减退
E. 便秘

正确答案：D。性功能减退

解析：本题考查药物的不良反应。西咪替丁为组胺H₂受体拮抗剂，主要不良反应为性功能减退（D对）以及肝损害。